六腑的主要生理功能是
A. 化生精气
B. 储存精气
C. 藏而不泄
D. 传化物而不藏
E. 排泄水液

正确答案：D。传化物而不藏

解析：本题考查的是六腑的生理功能。六腑的主要生理功能是传化物而不藏（D对）。脏腑分类：根据脏腑的生理功能特点，分为三类：一是五脏，即心、肺、脾、肝、肾；二是六腑，即胆、胃、小肠、大肠、膀胱、三焦；三是奇恒之腑，即脑、髓、骨、脉、胆、女子胞。五脏主藏精气（B错），以藏为主，藏而不泄（C错）；六腑传化水谷，传化物而不藏。化生精气（A错）为脾胃的生理功能。水谷之精气，依赖于脾胃的运化功能，才能从饮食水谷中化生。排泄水液（E错）为肺、脾、肾、三焦等脏腑的生理功能。